用纱布、棉花蘸取后涂搽皮肤或口腔黏膜的液体制剂是
A. 洗剂
B. 搽剂
C. 含漱剂
D. 灌洗剂
E. 涂剂

正确答案：E。涂剂

解析：本题考查涂剂。涂剂（E对）是指用纱布、棉花蘸取后涂搽皮肤或口腔黏膜的液体制剂；洗剂（A错）系指专供涂抹、敷于皮肤的外用液体制剂；搽剂（B错）系指专供揉搽皮肤表面的液体制剂；含漱剂（C错）系指用于咽喉、口腔清洗的液体制剂；灌洗剂（D错）分护理保健类洗液和阴道灌洗清洁液两类。